男，68岁。因脑梗塞住院半月，近一周出现高热、咳嗽，咳血痰。查体：T39.2℃，意识模糊，呼吸急促，口唇发绀，双肺散在湿啰音。血常规：WBC20×10⁹/L，N0.92。胸片：右肺大片状阴影，其中可见多个气囊腔。该患者最可能的是
A. 金黄色葡萄球菌肺炎
B. 肺炎链球菌肺炎
C. 肺炎支原体肺炎
D. 干酪性肺炎
E. 真菌性肺炎

正确答案：A。金黄色葡萄球菌肺炎

解析：患者为老年男性（为金黄色葡萄球菌肺炎的好发年龄），有脑梗塞的病史，近一周出现高热、咳嗽，咳血痰（为金黄色葡萄球菌肺炎的典型痰液表现），意识模糊，呼吸急促，口唇发绀，双肺散在湿啰音，WBC20×10⁹（正常值4～10×10⁹/L），N0.92（正常值0.4～0.75），提示存在感染，胸片示右肺大片状阴影，其中可见多个气囊腔（为金黄色葡萄球菌肺炎典型的胸片改变），根据其临床表现和辅助检查，考虑诊断为金黄色葡萄球菌肺炎（A对）。肺炎链球菌肺炎（P46）（B错）主要表现为寒战、高热，白细胞增高，X线表现为肺部大片炎性浸润阴影或实变影。肺炎支原体肺炎（P49）（C错）主要表现为乏力、咽痛、头痛、发热、咳嗽、食欲不振、腹泻、肌痛、耳痛，X线检查显示肺部多种形态的浸润影，呈节段性分布。干酪性肺炎（P68）（D错）多发生在机体免疫力和体质衰弱，又受到大量结核分枝杆菌感染的患者，X线影像呈大叶性密度均匀磨玻璃状阴影，逐渐出现溶解区，呈虫蚀样空洞。真菌性肺炎（P54）（E错）临床表现无特异性，X线表现无特异性，诊断时必须综合考虑宿主因素、临床特征、微生物学检查和组织病理学资料，病理学诊断仍是肺真菌病的金标准。